肠外营养时，使用大量高渗葡萄糖作为单一的能源会引起
A. 糖异生活跃
B. 静息能量消耗降低
C. 肝脏脂肪浸润
D. 去甲肾上腺素分泌减少
E. 蛋白质分解减少

正确答案：C。肝脏脂肪浸润

解析：葡萄糖的代谢必须依赖于胰岛素，但在严重应激状态下体内存在胰岛素抵抗，即使供给外源性胰岛素，糖的利用仍然较差。若使用大量高渗葡萄糖作为单一的能源会导致：①静息能量消耗增加（B错）；②CO₂产生过多；③脂肪肝综合征（C对）；④高血糖及高渗性并发症；⑤去甲肾上腺素分泌增多（D错）及其所致的神经内分泌系统反应；⑥机体脂肪增多，而蛋白质持续分解消耗（E错）；⑦体内有限的糖异生抑制（A错）。